垂盆草除清热解毒外，又能
A. 截疟
B. 止痒
C. 利咽
D. 活血
E. 利湿

正确答案：E。利湿

解析：本题考查垂盆草的功效。垂盆草除清热解毒外，又能利湿（E对）。鸦胆子【功效】清热解毒，燥湿杀虫，止痢截疟（A错），腐蚀赘疣。荆芥【功效】散风解表，透疹止痒（B错），止血。大青叶【功效】清热解毒，凉血消斑，利咽（C错）消肿。紫草【功效】凉血活血（D错），解毒透疹。